牙体缺损最常见的病因是
A. 龋病
B. 外伤
C. 磨损
D. 楔状缺损
E. 发育畸形

正确答案：A。龋病

解析：本题考查牙体缺损的病因。牙列缺损最常见的病因是龋病（A对），龋病是在以细菌为主的多因素作用下，牙体硬组织中无机物脱矿和有机物分解，导致牙体硬组织发生慢性进行性破坏。外伤（B错）如交通事故外伤、意外碰击或咬硬物等、牙在行使咀嚼功能时会产生生理性的磨耗，由于不良习惯和夜磨牙等原因可造成病理性磨损（C错）、多发生在牙唇侧、颊侧的牙颈部的楔状缺损（D错）及在牙发育和形成过程中出现的结构和形态异常造成的发育畸形（E错），这些都会造成牙列缺损，但都不如龋病常见。